男，7岁。右下后牙疼痛1周，脸肿3天。检查：大面积龋坏，叩痛（+++），龈颊沟变浅，扪及波动感，扪痛（+++），近中（牙合）面深龋洞，叩诊（-），温度测试同对照牙。X线显示：Ⅳ根分歧大面积低密度影，远中根吸收2/3，恒牙胚囊不连续，上方骨板模糊不清。龋近髓，骨硬板连续。初诊治疗方法是拔除引液，诊断是
A. 中龋
B. 深龋
C. 可复性牙髓炎
D. 牙髓充血
E. 慢性根尖周炎

正确答案：E。慢性根尖周炎

解析：本题考查儿童根尖周病。本病例中右下后牙疼痛1周，脸肿3天，患牙大面积龋坏，叩痛（+++），龈颊沟变浅，扪及波动感，扪痛（+++），可见患牙有急性根尖周炎表现，近中（牙合）面深龋洞，温度测试同对照牙，Ⅳ根分歧大面积低密度影可知患牙有慢性根尖周炎，因此可以诊断为慢性根尖周炎的急性发作（E对）。中龋（A错）和深龋（B错）都不会出现自发痛、叩痛和扪痛。可复性牙髓炎（C错）和牙髓充血（D错）是指同一种疾病的不同描述，温度测试会有一过性敏感，也不会有剧烈的叩痛。